按照苷键原子分类，属于氧苷的是
A. 氰苷
B. 酯苷
C. 氮苷
D. 酚苷
E. 吲哚苷

正确答案：A、B、D、E。氰苷；酯苷；酚苷；吲哚苷

解析：本题考查的是苷的分类。按照苷键原子分类，属于氧苷的是氰苷（A对）、酯苷（B对）、酚苷（D对）和吲哚苷（E对）。苷类又称配糖体，是糖或糖的衍生物如氨基糖、糖醛酸等与另一非糖物质通过糖的端基碳原子连接而成的化合物。依据苷键原子的不同，可分为O-苷、S-苷、N-苷（C错）和C-苷，其中最常见的是氧苷。氧苷以苷元不同又可分为醇苷、酚苷、氰苷、酯苷和吲哚苷。